属于亚氨基酸的是
A. 脯氨酸
B. 组氨酸
C. 甘氨酸
D. 色氨酸
E. 赖氨酸

正确答案：A。脯氨酸